扁平足常见于
A. 坐姿作业
B. 立姿作业
C. 流水线作业
D. 视屏作业
E. 精细作业

正确答案：B。立姿作业